慢性肾功能不全恶化的常见诱因，应除外的是
A. 感染、发热
B. 外伤、失血
C. 呕吐伴腹泻
D. 血尿酸或血钙过低
E. 心力衰竭

正确答案：D。血尿酸或血钙过低

解析：感染、发热（A对），外伤、失血（B对），呕吐伴腹泻（C对），心力衰竭（E对）均可引起有效循环血容量不足，肾脏灌注减少，导致慢性肾功能不全进恶化。血尿酸或血钙过高（D错，为本题正确答案）易引起泌尿系结石，导致慢性肾功能不全恶化。